患者虽躯体疾病已康复，但患者的依赖性加强，安心于已适应的患者生活模式，不愿返回原来的工作环境，这属于
A. 角色行为适应
B. 角色行为缺如
C. 角色行为强化
D. 角色行为减退
E. 角色行为异常

正确答案：C。角色行为强化

解析：角色行为强化：患者虽然躯体疾病已康复，但患者的依赖性加强和自信心减弱，对承担原来的社会角色恐慌不安，心理上产生了“衰弱感”或想继续享受“舒适感”，安心于已适应的患者生活模式，不愿重返原来的生活环境。掌握“患者角色和求医行为”知识点。